测定马钱子中士的宁的含量用
A. 高效液相色谱法
B. 薄层扫描法
C. 气相色谱法
D. 分光光度法
E. 酸碱滴定法

正确答案：A。高效液相色谱法